由生物医学模式转到生物心理社会医学模式，要求临床医师
A. 不仅关心患者的躯体。而且关心患者的心理
B. 注意克服物化趋势
C. 维护和尊重患者的知情同意权
D. 正确处理同行关系
E. 不能以医谋私

正确答案：A。不仅关心患者的躯体。而且关心患者的心理